初产妇第一产程活跃期延长是指活跃期超过
A. 4小时
B. 6小时
C. 8小时
D. 10小时
E. 12小时

正确答案：C。8小时

解析：初产妇第一产程活跃期延长是指活跃期超过8小时（C对）。